某女63岁，患胃病多年，症见脘腹疼痛，喜温喜按，噪杂吞酸，食少，证属脾胃虚寒，宜选用的成药是
A. 良附丸
B. 香砂养胃丸
C. 香砂平胃丸
D. 附子理中丸
E. 小建中合剂

正确答案：E。小建中合剂

解析：本题考查的是小建中合剂的主治。患胃病多年，症见脘腹疼痛，喜温喜按，噪杂吞酸，食少，证属脾胃虚寒，宜选用的成药是小建中合剂（E对）。小建中合剂：【主治】脾胃虚寒所致的脘腹疼痛、喜温喜按、嘈杂吞酸、食少；胃及十二指肠溃疡见上述证候者。良附丸（A错）：【主治】寒凝气滞，脘痛吐酸，胸腹胀满。香砂养胃丸（B错）：【主治】胃阳不足、湿阻气滞所致的胃痛、痞满，症见胃痛隐隐、脘闷不舒、呕吐酸水、嘈杂不适、不思饮食、四肢倦怠。香砂平胃丸（C错）：【主治】湿浊中阻、脾胃不和所致的胃脘疼痛、胸膈满闷、恶心呕吐、纳呆食少。附子理中丸（D错）：【主治】脾胃虚寒所致的脘腹冷痛、呕吐泄泻、手足不温。